患者，男，59岁，哮喘病史8年，近日因急性脑梗死就诊，住院治疗2周后出院。对于该患者脑血管病的二级预防，宜选用的抗血小板药物是
A. 氯吡格雷
B. 阿司匹林
C. 对乙酰氨基酚
D. 华法林
E. 依诺肝素

正确答案：A。氯吡格雷

解析：本题考查抗血小板药。阿司匹林的主要不良反应为胃肠道出血或对阿司匹林过敏，其中过敏性哮喘较多见，该患者有哮喘病史8年，不宜服用阿司匹林（B错），改用氯吡格雷（A对）替代治疗。对乙酰氨基酚（C错）为退热药首选。华法林（D错）为抗凝血药物。依诺肝素（E错）可用于抗凝治疗。